能够干扰谷氨酰胺参与合成嘌呤核苷酸的物质是
A. 氮杂丝氨酸
B. 6-巯基嘌呤
C. 5-氟尿嘧啶
D. 甲氨蝶呤
E. 阿糖胞苷

正确答案：A。氮杂丝氨酸